黄连的主治病证不包括
A. 痈肿疮毒
B. 湿热泻痢
C. 胃火牙痛
D. 肺热咳喘
E. 血热吐衄

正确答案：D。肺热咳喘

解析：本题考查的是黄连的主治病证。黄连的主治病证不包括肺热咳喘（D错，为本题正确答案）。黄连：【主治病证】（1）湿热痞满、呕吐、泻痢（B对）、黄疸。（2）热病高热、烦躁、神昏，内热心烦不寐，胃火牙痛（C对）、口舌生疮。（3）肝火犯胃之呕吐吞酸。（4）血热妄行吐衄（E对），痈疽肿毒，目赤肿痛，耳道疖肿，湿热疮疹（A对）。肺热咳喘为黄芩的主治病证。黄芩：【主治病证】（1）湿温，暑湿，湿热胸闷、黄疸、泻痢、淋痛、疮疹。（2）热病烦渴，肺热咳喘，少阳寒热，咽痛，目赤，火毒痈肿。（3）血热之吐血、咳血、衄血、便血、崩漏。（4）胎热之胎动不安。